8个月男孩，持续高热，频咳，精神萎靡5天，近2天气促加重，今抽搐3次，全身性发作，嗜睡。查体：体温40.0℃，呼吸56次/分，心率148次/分，双肺少量中细湿啰音，左下肺可闻管状呼吸音，白细胞计数4.0×10⁹/L，腰椎穿刺颅压稍高，脑脊液常规正常。最可能的诊断是
A. 肺炎链球菌肺炎
B. 金黄色葡萄球菌肺炎
C. 支原体肺炎
D. 毛细支气管炎
E. 腺病毒肺炎

正确答案：E。腺病毒肺炎

解析：该患儿持续高热40℃呈稽留热，频繁咳嗽，精神萎靡，嗜睡，气促加重，心率加快，双肺湿啰音表现，均符合腺病毒肺炎的表现（E对）。肺炎链球菌肺炎后可有痰呈铁锈色（A错）。金黄色葡萄球菌肺炎发热多呈弛张热型，早产儿和体弱儿有时可无发热或仅有低热（B错）。咳嗽为支原体肺炎的突出的症状，初为干咳，后转为顽固性剧咳，肺部体征多不明显，甚至全无（C错）。